唯一从脑干后面出脑的脑神经是
A. 动眼神经
B. 滑车神经
C. 面神经
D. 前庭蜗神经
E. 展神经

正确答案：B。滑车神经

解析：滑车神经（B对）为运动性脑神经，细小。起于中脑下丘平面对侧的滑车神经核，自中脑下丘（脑干）下方出脑，绕过大脑脚外侧前行，穿经海绵窦外侧壁向前，经眶上裂入眶，越过上直肌和上睑提肌向前内侧走行，支配上斜肌。